下列不属于参与Ⅱ相代谢的内源性极性小分子物质的是
A. 葡萄糖醛酸
B. 硫酸
C. 乳酸
D. 甘氨酸
E. 谷胱甘肽

正确答案：C。乳酸

解析：本题考查二相代谢。乳酸（C错，为本题正确答案）不属于第Ⅱ相生物转化内源成分。第Ⅱ相生物转化内源性的极性小分子包括葡萄糖醛酸（A对）、硫酸盐（B对）、氨基酸（D对）、谷胱甘肽（E对）等。